肺循环叙述错误的是
A. 肺静脉起自肺门
B. 左、右各1条肺静脉
C. 左、右各1条肺动脉
D. 肺静脉开口于左心房
E. 肺动脉内流动的是静脉血

正确答案：B。左、右各1条肺静脉

解析：肺静脉起自肺门（A对）。左、右各2条（B错，为本题正确答案）肺静脉。左、右各1条肺动脉（C对）。肺静脉开口于左心房（D对）。肺动脉内流动的是静脉血（E对）。